男，30岁。发作性头晕、头痛，伴面色苍白、心悸、冷汗9个月。每次持续20分钟左右，发作时BP180～220/110～140mmHg，平素血压正常，查体：BP120/80mmHg，体型偏瘦，心率90次/分，律齐，四肢末梢凉。对明确诊断最有帮助的是在发作时检测
A. 血皮质醇
B. 血醛固酮
C. 血儿茶酚胺
D. 血电解质
E. 血浆肾素活性

正确答案：C。血儿茶酚胺

解析：青年男性患者，阵发性高血压，发作时BP180～220/110～140mmHg，平素血压正常，伴面色苍白、心悸、冷汗、头晕、头痛症状，每次持续20分钟左右（嗜铬细胞瘤典型表现），提示嗜铬细胞瘤。嗜铬细胞瘤可间断释放大量儿茶酚胺而致病，表现为阵发性高血压型，疑诊时需测定发作后血或尿儿茶酚胺（C对）。血醛固酮（B错）与血电解质（D错）用于原发性醛固酮增多症的诊断。血皮质醇（A错）用于库欣综合征的诊断。血浆肾素活性（E错）指血浆中内源性肾素催化血管紧张素原产生血管紧张素Ⅰ的速率，升高见于肾性高血压症、肾小球旁器细胞瘤等疾病，降低可见于原发性醛固酮增多症、肾上腺糖皮质激素反应性酮固酮增多症等疾病。